脊髓灰质炎甲型肝炎等病毒的病毒体结构组成是
A. 核酸和刺突
B. 衣壳和包膜
C. 基质蛋白和衣壳
D. 核酸和衣壳
E. 核酸和包膜

正确答案：D。核酸和衣壳

解析：病毒的基本结构是由核心和衣壳构成的核衣壳。核心的主要成分就是核酸，构成病毒基因组，衣壳是包绕在核酸外面的蛋白质外壳，因此，病毒体的基本结构组成可理解为是核酸和衣壳，脊髓灰质炎病毒和甲型肝炎病毒的病毒体结构由核酸（RNA）和衣壳（D对）构成，无包膜(BE错）构成。刺突（A错）是包膜病毒包膜上的突起，化学成分是糖蛋白（P211）。基质蛋白（C错）是某些包膜病毒在核衣壳外层和包膜内层之间区域，其功能是把内部的核衣壳蛋白和包膜联系起来（P211-P212）。